男，41岁。3年来经常夜间上腹不适，2日前进油腻食，突然右上腹部阵发性绞痛伴恶心，入院时体温38℃，巩膜轻度黄染，有上腹肌紧张，压痛明显，肠鸣音弱，WBC16×10⁹/L，血清淀粉酶为128温氏单位，应首先考虑诊断为何种疾病
A. 急性阑尾炎
B. 急性胰腺炎
C. 溃疡穿孔
D. 急性化脓性胆囊炎
E. 胆道蛔虫症

正确答案：D。急性化脓性胆囊炎

解析：中年患者，长期夜间上腹不适病史，2日前进食油腻食物（诱因）引起右上腹部绞痛，入院体温38℃（低热，正常值36～37℃），巩膜轻度黄染（黄疸），右上腹肌紧张、压痛明显（Murphy征阳性），WBC16×10⁹/L（感染；正常值4～10×10⁹/L），血清淀粉酶为128U/dL（正常值40～180U/dL），根据临床表现及相关检查，首先考虑诊断为急性化脓性胆囊炎（D对）。急性阑尾炎（A错）应有右下腹麦氏点压痛及转移性右下腹痛。急性胰腺炎（B错）多为左上腹疼痛，可向左肩或左腰背部放射，血淀粉酶常升高超过500U/dl。溃疡穿孔（C错）上腹“刀割样”剧痛，波及全腹。胆道蛔虫症（E错）常突发剑突下钻顶样剧烈绞痛，剧烈的腹痛与较轻的腹部体征不相称。